手三阳经腧穴主治相同的病证是
A. 胃肠病
B. 咽喉病
C. 头面病
D. 神志病
E. 耳病

正确答案：B。咽喉病

解析：手三阳经和足少阴经主治咽喉病（B对）；足三阳经同治神志病（D错）、热病；足阳明经主治胃肠病（A错）；手少阳三焦经、手太阳小肠经和足少阳胆经主治耳病（E错）。腧穴的分部主治与腧穴的位置特点关系密切，如位于头面的穴，以治疗头面（C错）五官病证为主，手三阳经分部治疗经脉循行相应面部疾病，不是相同的病证。